以下哪种学说的不足之处为“缺乏病理学、生物化学的实验依据，至今尚未发现釉质龋是由蛋白质溶解开始的证据”
A. 蛋白溶解学说
B. 化学细菌学说
C. 龋病病因的四联因素理论
D. 广义龋病生态学假说
E. 蛋白溶解-螯合学说

正确答案：A。蛋白溶解学说

解析：蛋白溶解学说由Gottlieb和Frisbie等（1947）提出。此学说由于缺乏病理学、生物化学的实验依据，至今尚未发现釉质龋是由蛋白质溶解开始的证据。掌握“龋病概述”知识点。